骨肉瘤X线表现为
A. 骨膜反应
B. 瘤骨形成
C. 骨质结构改变
D. 软组织肿块形成
E. 以上说法均正确

正确答案：E。以上说法均正确

解析：本题考查骨肉瘤X线表现。骨肉瘤X线表现为骨膜反应（A对）、瘤骨形成（B对）、骨质结构改变（C对）、软组织肿块形成（D对）。综上，选E。骨肉瘤：颌骨原发性恶性肿瘤最常见者为骨肉瘤，也是恶性度较高的原发性骨肿瘤。骨肉瘤的影像学表现有溶骨和成骨之分，其主要X线表现为：①骨质结构改变；②瘤骨形成；③骨膜反应；④软组织肿块形成。